在维护治疗期探诊深度少于多少的部位可不做龈下刮治术
A. ≤1mm
B. ≤2mm
C. ≤3mm
D. ≤4mm
E. ≤5mm

正确答案：C。≤3mm

解析：本题考查牙周病的疗效维护和预防。维护治疗即牙周支持治疗，是预防牙周病复发、维持牙周治疗长期疗效的唯一有效手段。在进行相应治疗时，全口洁治和口腔卫生指导是必不可少的。对于口腔卫生良好的患者，也可进行预防性洁治。在维护治疗期探诊深度≤3mm（C对）的部位可不做龈下刮治术，以免造成进一步的附着丧失。